左旋多巴应用初期，最常见的不良反应是
A. 迟发性运动障碍
B. 开-关现象
C. 胃肠道反应
D. 精神障碍
E. 心律失常

正确答案：C。胃肠道反应